为儿童配备安全座椅属于预防意外伤害的
A. 主动干预
B. 教育干预
C. 技术干预
D. 强制干预
E. 紧急处置

正确答案：C。技术干预